下列哪项不属于指下有脉气紧张之感觉的脉象
A. 长脉
B. 弦脉
C. 革脉
D. 牢脉
E. 紧脉

正确答案：A。长脉

解析：长脉的脉象特点是脉搏的搏动范围显示较长，超过寸、关、尺三部。首尾端直，如循长竿（A错，为本题正确答案）。弦脉（B对）的脉象特点是脉形端直而形长，脉势较强、脉道较硬，切脉时有挺然指下、直起直落的感觉。革脉（C对）的脉象特点是浮取感觉脉管搏动的范围较大，硬而搏指，重按则乏力，有豁然而空之感，外坚中空如以指按压鼓皮之状。牢脉（D对）的脉象特点是脉位沉，应指范围超过寸、关、尺，脉势实大而弦，牢脉轻取、中取均不应，沉取始得，但搏动有力，势大形长，为沉、弦、大、实、长五种脉象的复合脉。紧脉（E对）的脉象特点是脉势紧张有力，坚搏抗指，且有旋转绞动或左右弹指的感觉。